患者，男，66岁。体检时发现血糖高前来就诊，有磺胺药过敏史，体型肥胖。医师处方二甲双胍片（0.5g，tid）控制血糖。该患者复诊发现糖耐量异常及餐后血糖升高，单药控制未达标，建议联合应用的降糖药是
A. 格列喹酮
B. 格列苯脲
C. 胰岛素
D. 阿卡波糖
E. 罗格列酮

正确答案：D。阿卡波糖

解析：本题考查阿卡波糖。阿卡波糖（D对）是α-葡萄糖苷酶抑制剂，能够抑制单糖吸收，减慢碳水化合物水解以及产生葡萄糖的速度，降低餐后血糖峰值。适用于以碳水化合物为主要食物成分和餐后血糖升高的患者。格列喹酮（A错）和格列苯脲（B错）是磺酰脲类促胰岛素分泌药，可降低餐后血糖水平但不能影响糖耐量。胰岛素（C错）主要通过注射给药，使用不方便。罗格列酮（E错）是胰岛素增敏剂，对糖耐量无影响。